下列疾病，可以出现凝血时间缩短的是
A. 先天性凝血酶原缺乏症
B. 纤维蛋白原缺乏症
C. DIC早期
D. 血小板减少性紫癜
E. 严重肝病

正确答案：C。DIC早期

解析：可以出现凝血时间缩短的是DIC早期（C对），DIC（弥漫性小血管内凝血）早期，血液处于高凝状态，CT（凝血时间）缩短。先天性凝血酶原缺乏症（A错）缺乏凝血酶原、纤维蛋白原缺乏症（B错）缺乏纤维蛋白原，使CT延长。血小板减少性紫癜（D错），由于血小板减少，有出血倾向，故CT延长。凝血因子主要在肝脏中产生，严重肝病（E错）患者凝血因子缺乏，故CT延长。